某眼科医师在治疗肝胃火盛所致的目赤肿痛、眼缘溃烂、畏光怕风，眼角涩痒时，除了给患者处以相应的汤剂内服外，常配以八宝眼药散点眼以增强疗效。此因该中成药除能消肿止痛外，还能
A. 退翳明目
B. 清热散风
C. 燥湿明目
D. 平肝明目
E. 泻火明目

正确答案：A。退翳明目

解析：本题考查的是八宝眼药散的功能。八宝眼药散除能消肿止痛外，还能退翳明目（A对）。八宝眼药散：【功能】消肿止痛，退翳明目。明目蒺藜丸：【功能】清热散风（B错），明目退翳。秦皮：【功效】清热解毒，燥湿止带，清肝明目（C错）。桑叶：【功效】疏散风热，清肺润燥，平肝明目（D错），凉血止血。黄连羊肝丸：【功能】泻火明目（E错）。